内囊后肢豆丘部的位置在
A. 豆状核与尾状核之间
B. 丘脑和尾状核之间
C. 苍白球和壳之间
D. 丘脑和豆状核之间
E. 苍白球和尾状核之间

正确答案：D。丘脑和豆状核之间

解析：内囊可分为前肢、膝和后肢三部。前肢位于豆状核与尾状核之间（A错）；后肢又可分为豆丘部、豆状核后部、豆状核下部，其中豆丘部位于丘脑和豆状核之间（D对）；膝部位于前、后肢之间。